关于被动扩散（转运）特点的说法，错误的是
A. 不需要载体
B. 不消耗能量
C. 是从高浓度区域向低浓度区域的转运
D. 转运速度与膜两侧的浓度差成反比
E. 无饱和现象

正确答案：D。转运速度与膜两侧的浓度差成反比

解析：本题考查药物的转运方式。被动转运的特点为转运速度与膜两侧的浓度差成正比（D错，为本题正确答案）；被动转运的特点还包括：①不需要载体（A对）；②不消耗能量（B对）；③从高浓度区域向低浓度区域的转运（C对）；④无饱和现象（E对）等。